医疗机构临床用血应当制定用血计划，遵循
A. 公平公正的原则
B. 慎用原则的原则
C. 准确慎用的原则
D. 合理科学的原则
E. 勤査深入的原则

正确答案：D。合理科学的原则

解析：《献血法》规定，医疗机构临床用血应当制定用血计划，遵循合理、科学的原则（D对），不得浪费和滥用血液。